女，53岁。近1年来怕脏，不敢倒垃圾和上厕所。在街上遇到垃圾车也害怕，会反复洗手。自己知道不应该，但不能控制，为此感到苦恼而就诊。患者的诊断是
A. 分离障碍
B. 疑病障碍
C. 恐惧性焦虑障碍
D. 广泛性焦虑障碍
E. 强迫障碍

正确答案：E。强迫障碍

解析：患者老年女性，近一年来怕脏，在街上遇见垃圾车也会害怕（表现为“怕受污染”的强迫观念），不敢倒垃圾和上厕所，反复洗手（强迫行为），自己知道不应该，但无法控制，并为此感到苦恼（强迫与反强迫的强烈冲突，且患者为此感到苦恼），根据患者的典型症状，可以明确诊断为强迫障碍（E对）。分离障碍（A错）主要表现为遗忘、漫游、人格改变，且可出现具有发泄特点的情感爆发。疑病障碍（B错）主要表现为患者坚信自己患有严重的疾病，正常的感觉被患者视为异常。恐惧型焦虑障碍（C错）即恐惧症是一种以过分和不合理地惧怕外界某种客观事物或情景为主要表现，患者明知这种恐惧反应是过分的或不合理的，但仍反复出现，难以控制。广泛性焦虑障碍（P130）（D错）是一种主要表现为不明原因的提心吊胆、紧张不安。